口腔科手机最有效的灭菌方法为
A. 压力蒸汽灭菌法
B. 干热灭菌
C. 低温蒸汽甲醛气体消毒、灭菌
D. 浸泡灭菌
E. 预真空高温高压灭菌法

正确答案：E。预真空高温高压灭菌法

解析：本题考查口腔器械的消毒与灭菌及医疗废物处理。手机内部轴承管道结构精细，内表面无法进入清洁。这些特点决定了手机清洁消毒的特殊性。同时高品质的手机价格昂贵，如何养护手机、延长其使用寿命也很重要。综上所述，化学消毒剂、微波、紫外线等消毒方法仅适用于手机表面的消毒灭菌，而不能杀灭手机内部的病原微生物。化学消毒法还存在着对人体的刺激和手机部件的腐蚀性等问题。因此，预真空高温高压灭菌法（E对）是目前对口腔科手机最有效的灭菌方法。